对咀嚼系统最有利的生物杠杆是
A. Ⅰ类
B. Ⅱ类
C. Ⅲ类
D. A+B
E. 都不是

正确答案：C。Ⅲ类

解析：本题考查咀嚼过程、类型，咀嚼周期及生物力。在切割运动中，以前牙切咬的食物为重点，颞下颌关节为支点，升颌肌群以咬肌、颞肌为主要动力点，形成第Ⅲ类杠杆（C对），阻力臂长与动力臂，机械效能低，但前牙所承受的咀嚼力较小，有利于维护狭小的单根前牙和其他牙周组织的健康。